初产妇第二产程不应超过
A. 30分钟
B. 1小时
C. 90分钟
D. 3小时
E. 150分钟

正确答案：D。3小时

解析：根据八版妇产科学：初产妇第二产程不应超过2小时（D对）。第一产程初产妇需11～12小时，经产妇需6～8小时。不应超过30分钟（A错）为第三产程。九版妇产科学：第二产程初产妇不应超过3小时。